下列表述中正确的有
A. 吗啡是两性药物
B. 吗啡的氧化产物为双吗啡
C. 吗啡结构中有甲氧基
D. 天然吗啡水溶液呈左旋
E. 吗啡结构中含哌嗪环

正确答案：A、B、D。吗啡是两性药物；吗啡的氧化产物为双吗啡；天然吗啡水溶液呈左旋

解析：本题考查吗啡。吗啡因结构中含有酚羟基和叔氮原子，显酸碱两性（A对）。吗啡及其盐类具有还原性，在光照下能被空气氧化，可生成伪吗啡（又称双吗啡）（B对）和N-氧化吗啡。吗啡是具有菲环结构的生物碱，由五个环稠合而成，具有五个手性中心，多种旋光异构体，其中左旋吗啡为有效的吗啡构型，也是天然吗啡的存在形式（D对）。吗啡是由五个环稠合而成的生物碱，N原子所在的环为哌啶环（E错），甲基连接在哌啶环上的N原子上，因此不含有甲氧基（C错）。